口腔颌面部损伤的创口常被细菌和尘土等污染，易致感染而增加损伤的复杂性和严重性，颌面战伤创口的感染率更高，约占有的比例是
A. 0.1
B. 0.2
C. 0.3
D. 0.5
E. 0.8

正确答案：B。0.2

解析：口腔颌面部损伤的创口常被细菌和尘土等污染，易致感染而增加损伤的复杂性和严重性，颌面战伤创口的感染率更高，约为20%。掌握“口腔颌面部创伤急救”知识点。